目前对学习概念的定义是
A. 通过学校教育以增加自己的理论知识技能的过程
B. 通过实践以增加自己的工作经验生活经验和社交经验的过程
C. 通过观察别人言行而改变自己不良行为习惯的过程
D. 通过练习而促使自己行为发生相对持久变化的过程
E. 通过读书实践以增加自己适应社会工作生活能力的过程

正确答案：D。通过练习而促使自己行为发生相对持久变化的过程

解析：学习概念是行为理论的核心，行为治疗技术实际上是一些获得、消除和改变行为的学习过程。行为学习的理论来源主要有三个方面：经典条件反射理论、操作性条件反射理论、社会学习理论。这三种理论的一个共同点就是学习，它们都是关于有机体的学习的发生机制和条件的理论。学习是获得行为和改变行为的主要途径。无论是适应的行为还是不适应的行为，都产生于学习。学习的概念定义就是通过练习而促使自己行为发生相对持久变化的过程（D对）。